慢性特发性血小板减少性紫癜合并贫血最适宜的检查是
A. 血清铁蛋白测定
B. 血清叶酸测定
C. 血红蛋白电泳
D. 酸溶血试验
E. 红细胞渗透脆性试验

正确答案：A。血清铁蛋白测定

解析：慢性特发性血小板减少性紫癜合并贫血多由失血引起，常为正常细胞性或小细胞低色素性贫血，小细胞低色素性贫血最常见的原因是缺铁，故最适宜的检查是血清铁蛋白测定（A对）。血清叶酸测定（P546）（B错）主要用于巨幼细胞性贫血的检查；血红蛋白电泳（C错）主要用于血红蛋白病的检查；酸溶血试验（Ham试验）（P560）（D错）主要用于阵发性睡眠性血红蛋白尿的检查；红细胞渗透性脆性试验（P553）（E错）主要用于遗传性球形细胞增多症的检查。